口服液体制剂中，药物分散度最大的不稳定体系是
A. 高分子溶液剂
B. 低分子溶液剂
C. 乳剂
D. 混悬剂
E. 溶胶剂

正确答案：D。混悬剂

解析：本题考查混悬剂。口服液体制剂中，药物分散度最大的不稳定体系是混悬剂（D对）。混悬剂系指难溶性固体药物以微粒状态分散于分散介质中形成的非均匀的液体制剂。混悬剂中药物微粒的分散度大、具有较高的表面自由能，而处于不稳定状态。